韧带肌腱的部分撕裂属
A. 挤压伤
B. 扭伤
C. 挫伤
D. 裂伤
E. 冲击伤

正确答案：B。扭伤

解析：扭伤：指关节部位一侧受到过大的牵张力，相关韧带超过了正常的活动范围而造成的损伤。如关节过度屈伸或扭转造成关节囊、韧带、肌腱的部分撕裂（B对）。压伤（A错）：为肌肉丰富的肢体或躯干被重物挤压所致，伤处有较广泛的组织破坏、出血或坏死。挫伤（C错）：因钝性暴力或重物打击、碰撞所致的皮下组织、肌肉或体内组织器官的损伤。裂伤（D错）：为钝器打击所引起的皮肤及深层软组织裂开，创缘不整齐，周围组织破坏严重，并且较为广泛，容易出现受损组织的坏死和感染。冲击伤：又称爆震伤，是由强烈爆炸物产生高压气浪形成的冲击波所致损伤。其特点是体表无明显损伤，而体腔内脏器却遭受严重而广泛的损伤（E错）。